女，48岁。近一个月感口渴饮水量增至每天2000毫升。身高156厘米、体重71公斤。空腹血糖180mg/dl（10.0mmol/L）餐后血糖252mg/dl（14.0mmol/L）。系初次发现血糖高，过去无糖尿病史，给予相应治疗三个月后空腹血糖153mg/dl（8.5mmol/L），餐后血糖225mg/dl（12.5mmol/L）。进一步治疗建议
A. 氯磺丙脲
B. 格列齐特
C. 二甲双胍
D. 阿卡波糖
E. 正规胰岛素

正确答案：C。二甲双胍

解析：中年女性患者，出现口渴、多饮（糖尿病典型症状），空腹血糖＞7.0 mmol/L，餐后血糖＞11.1 mmol/L，体重指数为29.2（体重指数=体重（kg）/身高²（m²），正常值为18.5～24.9，＞29则提示肥胖），既往无糖尿病史，考虑诊断为2型糖尿病。糖尿病的治疗首先采用生活方式干预，当生活方式干预达3个月仍不能控制血糖至理想范围时，应采取药物治疗。二甲双胍（C对）不增加体重，并可改善血脂谱、增加纤溶系统活性，被认为可能有助于延缓或改善糖尿病血管并发症，尤其适用于肥胖患者，因此本例患者药物治疗首选二甲双胍治疗。氯磺丙脲（A错）、格列齐特（B错）均属磺脲类降糖药，为胰岛素促泌剂，有增加体重的副作用，不宜用于本例患者。阿卡波糖（D错）为α-葡萄糖苷酶抑制剂，主要用于餐后高血糖的治疗，本例患者空腹与餐后血糖均高，应用阿卡波糖降糖效果不好。初诊2型糖尿病患者胰岛功能尚存，使用口服降糖药物即可控制血糖，后期胰岛功能衰竭、产生并发症及急性应激时，才选择胰岛素（E错）。